在进行费用效益分析时，应计算
A. 直接卫生费用
B. 间接卫生费用
C. 两者都包括
D. 视具体情况而定
E. 其他

正确答案：C。两者都包括

解析：本题考查费用效益分析。在进行费用效益分析时，为了全面衡量因病伤造成的社会经济损失，必须要计算并分析直接费用和间接费用（C对ABDE错），才能对卫生服务的投入与产出作出全面的评价。